女，35岁，已婚。10小时前出现上腹部胀痛，6小时前疼痛转移至右下腹，伴恶心、呕吐、发热。查体：右下腹压痛、反跳痛阳性，肠鸣音减弱。血常规：白细胞总数及中性粒细胞分类升高。术后5天，患者出现下腹坠胀、大便频繁、里急后重，伴尿频、尿痛。最可能的原因是
A. 急性肠炎
B. 急性附件炎
C. 泌尿系统感染
D. 阑尾残株炎
E. 盆腔脓肿

正确答案：E。盆腔脓肿